患者，女，45岁，身高160cm，体重75kg，临床诊断为Ⅱ型糖尿病。实验室检查：空腹血糖8.7mmol/L（正常值：3.9～6.1mmol/L），餐后2h血糖13.1mmol/L（正常值：<7.8mmol/L），糖化血红蛋白7.1%（正常值：4.8%～6.0%）。经饮食控制，规律锻炼，血糖控制仍未达到理想水平。该患者糖尿病治疗，应首选的药物是
A. 胰岛素
B. 格列齐特
C. 二甲双胍
D. 胰岛素+二甲双胍
E. 罗格列酮+二甲双胍

正确答案：E。罗格列酮+二甲双胍

解析：本题考查降糖药。该患者糖尿病治疗，应首选的药物是罗格列酮+二甲双胍（E对）。由题干可知，该患者身高160cm，体重75kg，为2型肥胖型糖尿病患者。二甲双胍是2型肥胖型糖尿病患者的首选用药，餐后血糖升高为主，伴餐前血糖轻度升高，首选罗格列酮。胰岛素（AD错）主要用于1型糖尿病。格列齐特（B错）主要用于2型非肥胖型糖尿病患者。